男，32岁。聚餐后出现右上腹疼痛2天，向右肩胛区放射。查体：T37.5℃，P90次/分，R18次/分，BP130/80mmHg，双肺呼吸音清，未闻及干湿性啰音，心率90次/分，心律齐，右上腹肌紧张，压痛（+），Murphy征（+）。最可能的诊断是
A. 急性胃炎
B. 右肾结石
C. 十二指肠球部溃疡
D. 急性胰腺炎
E. 急性胆囊炎

正确答案：E。急性胆囊炎

解析：男，32岁。聚餐后（诱因）出现右上腹疼痛2天，向右肩胛区放射。查体：T37.5℃（发热），P90次/分，R18次/分，BP130/80mmHg（血压上升），双肺呼吸音清，未闻及干湿性啰音，心率90次/分，心律齐，右上腹肌紧张，压痛（+），Murphy征（+）。根据病史、临床表现、体格检查，最可能的诊断是急性胆囊炎（E对）。